在药品批准文号格式中，体外化学诊断试剂在“国药准字”后的英文字母是
A. D
B. H
C. T
D. Y
E. Z

正确答案：C。T